目前效果最好的免疫抑制剂是
A. 硫唑嘌呤
B. 环孢霉素A（CsA）
C. 环磷酰胺
D. 糖皮质激素
E. FK-506

正确答案：E。FK-506